活血祛瘀药的适应证不包括
A. 关节痹痛
B. 癥瘕积聚
C. 痈肿疮疡
D. 阴疽流注
E. 月经不调

正确答案：D。阴疽流注

解析：本题考查的是活血祛瘀药的适应证。活血祛瘀药的适应证不包括阴疽流注（D错，为本题正确答案）。凡以通利血脉、促进血行、消散瘀血为主要功效的药物，称为活血祛瘀药或活血化瘀药，简称活血药。其中活血作用较强者，又称破血药。本类药主要适用于血行不畅、瘀血阻滞所引起的多种疾病，如瘀血内阻之闭经、痛经、月经不调（E对）、产后瘀阻腹痛、癥瘕（B对）、胸胁脘腹痛、跌打损伤肿痛、瘀血肿痛、关节痹痛（A对）、痈肿疮疡（C对）、瘀血阻滞经脉所致的出血等。阴疽流注是化痰止咳平喘药的适应证。凡以祛痰或消痰为主要功效的药物，称为化痰药；能减轻或制止咳嗽和喘息的药物，称为止咳平喘药。合之则称为化痰止咳平喘药。本类药主要适用于外感或内伤所致的咳嗽、气喘、痰多，或痰饮喘息，或因痰所致的瘰疬瘿瘤、阴疽流注、癫痫惊厥等。